一正常婴儿，体重7.5kg，身长68cm。前囟1.0cm，头围44cm。出牙4个。能独坐并能以拇、示指拿取小球。该儿最可能的月龄是
A. 8个月
B. 24个月
C. 18个月
D. 12个月
E. 5个月

正确答案：A。8个月

解析：1岁婴儿头围约为46cm，体重约为10kg，身长约为75cm。该儿童头围44cm，体重7.5kg，说明肯定在1岁以内。根据公式体重=（月龄+9）/2，计算儿童约为6个月。该婴儿可以独坐并能以拇、示指拿取小球，故应为8个月左右（A对）。
。